具有Ⅰ型观测线的基牙
A. 近缺隙侧倒凹区小，远离缺隙侧倒凹区大
B. 近缺隙侧倒四区小，远离缺隙侧倒区也小
C. 近缺隙侧倒凹区大，远离缺隙侧倒凹区小
D. 近缺隙侧倒凹区大，远离缺隙侧倒凹区也大
E. 近缺隙侧与远离缺隙侧均无倒凹区

正确答案：A。近缺隙侧倒凹区小，远离缺隙侧倒凹区大

解析：本题考查观测线。具有Ⅰ型观测线的基牙为近缺隙侧倒凹区小，远离缺隙侧倒凹区大（A对）。观测线的类型：由于义齿就位道方向设计以及各个基牙倾斜的方向和程度不同，所画出的观测线也不同，一般可有以下三种类型：（1）Ⅰ型观测线：为基牙向缺隙相反方向倾斜时所画出的导线，基牙上主要倒凹区在远离缺隙侧。（2）Ⅱ型观测线：为基牙向缺隙方向倾斜时所画出的导线，基牙上主要倒凹区在近缺隙侧。（3）Ⅲ型观测线：基牙的近、远缺隙侧均有明显倒凹或基牙向颊、舌侧倾斜时所形成的导线，导线位置靠近（牙合）面，倒凹普遍且显著。